糖尿病微血管并发症是
A. 糖尿病肾病
B. 糖尿病性冠心病
C. 糖尿病足
D. 糖尿病下肢动脉硬化闭塞症
E. 糖尿病性脑血管病

正确答案：A。糖尿病肾病

解析：由于微血管壁内PAS阳性物质沉积于内膜下，细血管基底膜增厚，可引起糖尿病肾病（A对）。大血管病变中血管有不同程度的动脉粥样硬化，主要侵犯主动脉、冠状动脉、脑动脉、肾动脉和肢体周围动脉等、引起冠心病（B错）、缺血性或出血性脑血管病（E错）、肾动脉硬化、肢体动脉硬化，可导致糖尿病下肢动脉硬化闭塞症（D错）。糖尿病足又称糖尿病性肢端坏疽，往往是下肢神经病变、微小血管病变和感染共同作用的结果（C错）。